男，64岁，糖尿病5年。急性起病，高热伴右胸痛，胸部X线片示右肺下叶实变影，其内可见多发气囊。其感染的病原体最可能是
A. 肺炎链球菌
B. 病毒
C. 肺炎克雷伯杆菌
D. 肺炎支原体
E. 金黄色葡萄球菌

正确答案：E。金黄色葡萄球菌

解析：患者老年男性，有糖尿病史。急性起病，高热伴右胸痛（金黄色葡萄球菌累及胸膜，引起胸痛），胸部X线片示右肺下叶实变影其内可见多发气囊（病变较大或融合时可有肺实变体征，气胸或脓气胸则有相应体征），根据患者症状和X线表现可诊断为葡萄球菌肺炎，是由金黄色葡萄菌感染所致（E对）。病毒（B错）性肺炎多为间质性肺炎，胸部X线特征性表现为肺纹理增多，磨玻璃状阴影，大叶实变者少见（P51）。肺炎克雷伯杆菌（C错）肺炎特征性表现是咳砖红色胶冻状痰，胸部X线表现为肺叶或肺段实变，蜂窝状脓肿，叶间隙下坠（P44）。肺炎支原体（D错）肺炎起病缓慢而非急性起病，多有乏力、肌痛、头痛等，胸部X线检查显示肺部多种形态的浸润影，呈节段分布，以肺下野多见（P49）。肺炎链球菌（A错）常导致肺炎链球菌肺炎无气胸或脓气胸相应体征。